女，18岁。下腹疼痛2个月。盆腔B超检查子宫大小正常，左侧宫旁探及6×5×3cm大小肿物，边界清。血清AFP900ug/L。最可能的诊断是
A. 卵巢畸胎瘤
B. 卵巢内胚窦瘤
C. 卵巢颗粒细胞瘤
D. 卵巢卵泡膜细胞瘤
E. 卵巢无性细胞瘤

正确答案：B。卵巢内胚窦瘤

解析：该患者为年轻女性（内胚窦瘤常见于儿童及年轻妇女），下腹疼痛2个月，盆腔B超检查子宫大小正常，左侧宫旁探及6×5×3cm大小肿物，边界清（内胚窦瘤多为单侧，较大，圆形或卵圆形），血清AFP（甲胎蛋白）升高达900ug/L（AFP血清正常值为＜20ug/L，瘤细胞可产生AFP，导致患者血清AFP升高，是诊断及病情监测的重要标志物），最可能的诊断是卵巢内胚窦瘤（B对）。卵巢畸胎瘤（P329）（A错）分为成熟畸胎瘤和未成熟畸胎瘤，其中未成熟畸胎瘤也可出现血清AFP升高，但一般达不到900ug/L。卵巢无性细胞瘤（P329）（E错）为卵巢恶性肿瘤，其中混合性无性细胞瘤中含卵黄囊成分者，可有血清AFP升高，但一般达不到900ug/L。卵巢颗粒细胞瘤（P330）（C错）和卵巢卵泡膜细胞瘤（P330）（D错）同属于卵巢性索间质肿瘤，两者常同时存在，可分泌雌激素，常合并子宫内膜增生甚至子宫内膜癌，无血清AFP升高。